以上哪种疾病的病理特点为伴有明显骨吸收和死骨形成的化脓性病灶
A. Garré骨髓炎
B. 放射性骨髓炎
C. 牙周炎静止期
D. 慢性化脓性骨髓炎
E. 天疱疮

正确答案：D。慢性化脓性骨髓炎

解析：慢性化脓性骨髓炎：主要病理表现为伴有明显骨吸收和死骨形成的化脓性病灶。掌握“急慢性化脓性颌骨骨髓炎”知识点。